细菌“核质以外的遗传物质”指
A. mRNA
B. 核糖体（核蛋白体）
C. 质粒
D. 异染颗粒
E. 性菌毛

正确答案：C。质粒

解析：细菌是原核细胞，不具有成形的核，核质是细菌的遗传物质，又称为拟核，细菌核质以外的的遗传物质是质粒（C对），存在于细胞质中。mRNA（A错）是信使RNA，它携带遗传信息，在蛋白质合成时充当模板。核糖体（核蛋白体）（B错）是细菌合成蛋白质的场所（P16）。异染颗粒（D错）是白喉棒状杆菌的生物学特性，主要成分是核糖核酸和多偏磷酸盐，对鉴定细菌具有重要意义（P164）。性菌毛（E错）又称F菌毛，仅见于少数革兰阴性菌，参与接合过程，可传递细菌的致育性（编码性菌毛的能力）、毒力、耐药性等，同时也是某些噬菌体吸附于细菌细胞的受体（P20）。